牛蒡子除宣肺利咽外，还能
A. 平肝明目
B. 解毒透疹
C. 清肺润燥
D. 疏肝
E. 息风止痉

正确答案：B。解毒透疹

解析：本题考查的是牛蒡子的功效。牛蒡子除宣肺利咽外，还能解毒透疹（B对）。牛蒡子：【功效】疏散风热，宣肺利咽，解毒透疹，消肿疗疮。桑叶：【功效】疏散风热，清肺润燥（C错），平肝明目（A错），凉血止血。薄荷：【功效】宣散风热，清利头目，利咽，透疹，疏肝（D错）。蝉蜕：【功效】疏散风热，透疹止痒，明目退翳，息风止痉（E错）。